HIV主要侵犯的靶细胞是
A. CD8⁺T淋巴细胞
B. 淋巴细胞
C. 单核巨噬细胞
D. 自然杀伤细胞
E. CD4⁺T淋巴细胞

正确答案：E。CD4⁺T淋巴细胞

解析：HIV主要侵犯宿主的CD4⁺细胞（E对）以及表达CD4分子的单核/巨噬细胞、树突状细胞和神经胶质细胞等。